男，24岁。左腕部切割伤12小时，伤及桡神经。其临床表现是
A. 拇、示、中指不能屈曲
B. 不能屈腕
C. 手部内在肌萎缩
D. 手背虎口区域麻木
E. 手掌桡侧感觉减弱

正确答案：D。手背虎口区域麻木

解析：患者桡神经损伤，其主要表现为伸腕、伸拇、伸指、前臂旋后障碍及手背桡侧（虎口区）感觉异常（D对），典型表现为垂腕（即屈腕）（B错）。拇、示、中指的屈曲障碍（A错）为正中神经损伤的表现。手部内在肌萎缩（C错）由尺神经损伤所致。手掌桡侧感觉减弱（E错）由正中神经损伤所致。